下列属于社区儿童心理卫生保健工作一级预防方法的是
A. 开展学校心理卫生宜教
B. 对新生进行心理评估
C. 使患病儿童青少年就诊
D. 规范心理咨询工作
E. 收集整理患病儿童资料

正确答案：A。开展学校心理卫生宜教